在下列药物中，治疗梅毒或因治疗梅毒服用汞剂所致汞中毒之肢体拘挛者应首选
A. 半边莲
B. 金银花
C. 防己
D. 百部
E. 土茯苓

正确答案：E。土茯苓

解析：土茯苓甘淡，解毒利湿，通利关节，又兼解汞毒，故可用治梅毒或因梅毒服汞剂中毒而致肢体拘挛、筋骨疼痛者，为治梅毒之要药（E对）。半边莲（A错）有较好的清热解毒作用，是治疗热毒所致疮痈肿痛之常用药。金银花（B错）甘寒，清热解毒，消散痈肿力强，为治热毒疮痈的要药，适用于各种热毒壅盛之外疡内痈，喉痹，丹毒。防己（C错）既能祛风除湿止痛，又能清热，对风湿痹证湿热偏盛，肢体酸重，关节红肿疼痛，及湿热身痛者，尤为要药。百部（D错）善于润肺下气止咳，治疗咳嗽，无论新久、寒热，尤以小儿顿咳、阴虚劳嗽为宜。